在两变量XY相关分析中，相关系数的正负取决于
A. X的取值
B. Y的取值
C. LXX
D. LYY
E. LXY

正确答案：E。LXY

解析：根据公式r=LXY/√LXXLYY可知相关系数的正负取决于LXY（E对）的正负情况。相关系数r没有单位，其取值范围：-1≤r≤1，其正负表示两变量间直线相关的方向，大于0为正相关，小于0为负相关，等于0为零相关。